对人体有毒的元素或化合物，主要是研究制订
A. 最低需要量
B. 最高需要量
C. 最高容许限量
D. 最低容许限量

正确答案：C。最高容许限量

解析：本题考查对人体有毒的元素或化合物的研究制订。对人体有毒的元素或化合物，主要是研究制订最高容许限量（C对ABD错）。